在医学上能够做到的
A. 就是伦理上应该做的
B. 在伦理上不一定是需要做的
C. 在伦理上是不应该做的
D. 在伦理上是缺乏根据的
E. 都是经过伦理学检验的

正确答案：B。在伦理上不一定是需要做的

解析：在现实中，医学决策同时也是极其复杂的思想、法律、伦理等人文或文化的决策：在科学、医学层面上有能力做的事，不一定就是在伦理上需要做的事（B对）。英国著名思想家大卫·休谟早就明确指出过这一矛盾：从“是什么”不能直接推导出“应该是什么”。这告诉人们，医学技术再成熟，它也无法同时解决价值选择问题：价值问题的解决只能诉诸医学人文素质。